红细胞的主要功能是
A. 提供营养
B. 缓冲温度
C. 运输激素
D. 运输O₂和CO₂
E. 提供铁

正确答案：D。运输O₂和CO₂